心衰时启动心率加快代偿反应机制是
A. 颈动脉窦压力感受器传入冲动减少
B. 主动脉弓压力感受器传入冲动增多
C. 心脏迷走神经紧张性增高
D. 心房压力下降
E. 以上都是

正确答案：A。颈动脉窦压力感受器传入冲动减少

解析：心衰时，心率加快代偿反应机制为：①心排血量减少，颈动脉窦（A对）和主动脉弓（B错）压力感受器传入冲动减少，经窦神经传到中枢的抑制性冲动减少，交感神经兴奋，引起心率加快；②心排血量减少使心腔内剩余血量增加，舒张期充盈压升高，刺激位于心房和心室的容量感受器，经迷走神经传入纤维至中枢，使心脏迷走神经紧张性降低（C错），交感神经兴奋；③若合并缺氧，还可刺激主动脉体和颈动脉体化学感受器，反射性引起心率加快。